切断感染性腹泻途径的主要措施
A. 到2025年腹泻导致的死亡率降到1‰以下
B. 前六个月纯母乳喂养婴儿
C. “三管一灭”
D. 设立腹泻病门诊
E. 轮状病毒疫苗接种

正确答案：C。“三管一灭”

解析：本题考查切断感染性腹泻传播途径的主要措施。切断感染性腹泻的传播途径主要采取以下三项措施：1.三管一灭（C对ABDE错）：即管理水源、粪便、饮食和消灭苍蝇，是我国多年提倡的感染性腹泻预防措施，实践证明是有效的，可大大降低感染性腹泻发病率；2.个人卫生：主要是饭前便后用肥皂洗手；3.改善饮食：主要是提倡喝安全饮用水和使用清洁水，提高婴儿母乳喂养率。